诊断伤寒肥达反应有参考意义的抗体效价是
A. O效价＞1:80,H效价＞1:160
B. O效价＞1:60,H效价＞1:80
C. O效价＞1:160,H效价＞1:160
D. O效价＞1:80,H效价＞1:80
E. 以上都不是

正确答案：A。O效价＞1:80,H效价＞1:160

解析：诊断伤寒肥达反应有参考意义的抗体效价是O效价＞1:80,H效价＞1:160（A对）（BCDE错）。